根据《药品生产质量管理规范》，必须使用独立的厂房与设施生产的药品种类是
A. 含生物碱类药品
B. 非甾体类药品
C. 青霉素类抗生素
D. 氨基糖苷类抗生素
E. 喹诺酮类抗生素

正确答案：C。青霉素类抗生素